城市社区健康教育基本内容不包括
A. 慢性非传染性疾病的社区防治
B. 加强安全教育，防止意外伤害
C. 家庭健康教育
D. 移风易俗，改变不良卫生习惯
E. 社会卫生公德与卫生法规教育

正确答案：D。移风易俗，改变不良卫生习惯